下列哪种牙周病的患者多有外周血中性粒细胞功能缺陷
A. 慢性龈缘炎
B. 青少年牙周炎
C. 成人牙周炎
D. 急性坏死溃疡性龈炎
E. 牙周萎缩

正确答案：B。青少年牙周炎

解析：本题考查局限型侵袭性牙周炎的病因。青少年牙周炎（B对）的患者多有外周血中性粒细胞功能缺陷。青春期牙周炎局部因素主要为特异性细菌的感染，全身因素主要是机体防御能力缺陷，特别是患者周围血的中性多形核白细胞趋化功能的异常，若同时存在其他的局部因素，则可加重病情的发展。